女，35岁。脸圆脸红向心性肥胖1年余。患者感明显的乏力与口干，腹部皮肤可见紫纹，皮肤薄，血压160/80mmHg，闭经1年。如果该患者胸部CT检查发现左肺有占位性病变，考虑的可能诊断是
A. 库欣病
B. 异位ACTH综合征
C. 肺部肿瘤
D. 肺部感染
E. 肺结核

正确答案：B。异位ACTH综合征

解析：本例患者向心性肥胖、腹部皮肤可见紫纹、皮肤薄、血压增高、闭经，为典型库欣综合征的表现，胸部CT检查发现左胸有占位性病变（胸部病变占异位ACTH综合征的60%左右，P701），应考虑异位ACTH综合征（B对）。异位ACTH综合征是指垂体以外的肿瘤（肺癌最多见）分泌ACTH，刺激肾上腺皮质分泌过多的皮质醇。本例患者以库欣综合征为主要临床表现，未出现肺部症状及体征，因此不应诊断为肺部肿瘤（C错）。库欣病（A错）为腺垂体ACTH分泌增多导致，多为垂体微腺瘤，无胸部占位性病变，行蝶鞍区影像学检查即可明确诊断。肺部感染（D错）多为急性病程，一般不会出现肺部占位性病变，且无库欣综合征的临床表现。肺结核（E错）的结核瘤虽可表现为占位性病变，但不会出现库欣综合征。